某男，6岁，厌食，面色萎黄，神疲多汗，大便稀薄，夹有未消化食物，形体偏瘦，肢倦乏力。治宜选用的方剂是
A. 消乳丸
B. 归脾丸
C. 四物汤
D. 清宁丸
E. 异功散

正确答案：E。异功散

解析：本题考查的是厌食的辨证论治。6岁，厌食，面色萎黄，神疲多汗，大便稀薄，夹有未消化食物，形体偏瘦，肢倦乏力。治宜选用的方剂是异功散（E对）。厌食，是指脾胃受纳运化功能失常所致的疾病，以较长时间的厌恶进食，食量减少为临床特征。西医学的厌食症可参考此内容辨证论治。（一）脾失健运证：【症状】食欲不振，厌恶进食，食而乏味，或伴胸脘痞闷，嗳气泛恶，偶尔多食则脘腹饱胀，大便不调，形体尚可，精神如常。舌淡红，苔薄白或薄腻，脉尚有力。【方剂应用】基础方剂为不换金正气散（陈皮、苍术、厚朴、草果、半夏、甘草、藿香、生姜、大枣）加减。（二）脾胃气虚证：【症状】不思进食，食不知味，神倦多汗，大便溏薄夹不消化食物，面色少华，形体偏瘦，肢倦乏力。舌淡，苔薄白，脉缓无力。【方剂应用】基础方剂为异功散（人参、白术、茯苓、陈皮、甘草）加减。（三）脾胃阴虚证：【症状】不思进食，食少饮多，皮肤失润，大便偏干，小便短黄，甚或烦躁少寐，手足心热。舌红少津，苔少或花剥，脉细数。【方剂应用】基础方剂为养胃增液汤（石斛、乌梅、沙参、玉竹、白芍、甘草）加减。消乳丸（A错）为积滞乳食内积证的方剂应用。积滞乳食内积证：【症状】不思乳食，嗳腐酸馊，或呕吐食物、乳片，脘腹胀满疼痛，大便酸臭或便秘，烦躁啼哭，夜眠不安，手足心热。舌质红，苔白厚，或黄厚腻，脉弦滑，或指纹紫滞。【方剂应用】基础方剂为乳积用消乳丸（香附、神曲、麦芽、陈皮、砂仁、甘草）加减；食积用保和丸（山楂、神曲、半夏、茯苓、陈皮、连翘、莱菔子）加减。归脾丸（B错）为眩晕气血亏虚证的中成药应用。眩晕气血亏虚证：【症状】眩晕动则加剧，劳累即发，面色淡白，神疲乏力，倦怠懒言，唇甲不华，发色不泽，心悸少寐，纳少腹胀。舌淡苔薄白，脉细弱。【中成药应用】常用中成药有归脾丸（大蜜丸）、益中生血片、参茸阿胶。四物汤（C错）为虚劳血虚证的方剂应用。虚劳血虚证：【症状】头晕眼花，心悸多梦，手足发麻，面色淡黄或淡白无华，口唇、爪甲色淡，妇女月经量少。舌质淡，脉细。【方剂应用】基础方剂为四物汤（熟地黄、当归、川芎、芍药）加减。中成药应用为清宁丸（D错）的病证，2022年考试指南未明确说明。